保和丸的组成中有
A. 陈皮、甘草
B. 茯苓、白术
C. 半夏、生姜
D. 神曲、银花
E. 山楂、连翘

正确答案：E。山楂、连翘

解析：保和丸组成为山楂、神曲、半夏、茯苓、陈皮、连翘、莱菔子（保和神曲与山楂，苓夏陈翘莱菔加，炊饼为丸白汤下，消食和胃效堪夸）（E对）。